两肺散在干湿啰音，其多少及部位不固定者，见于哪
A. 支气管扩张
B. 支气管哮喘
C. 心源性哮喘
D. 慢性支气管炎
E. 肺炎球菌肺炎

正确答案：D。慢性支气管炎

解析：两肺散在性湿啰音，常见于支气管炎、支气管肺炎、血行播散型肺结核、肺水肿（D对）。一侧或局限性湿啰音，常见于肺炎、肺结核（多在肺上部）、支气管扩张症（多在肺下部）、肺脓肿、肺癌等（A错）。支气管哮喘可闻及哮鸣音（B错）。心源性哮喘可闻及哮鸣音（C错）。肺炎球菌肺炎可闻及两下肺呼吸音减弱，干湿啰音较广泛（E错）。